恶性程度最低的甲状腺癌是
A. 鳞状上皮癌
B. 滤泡状腺癌
C. 髓样癌
D. 高分化癌
E. 乳头状腺癌

正确答案：E。乳头状腺癌

解析：乳头状癌：起源于甲状腺滤泡上皮细胞，多见于中青年人，约占成人甲状腺癌的70%。分化好，生长缓慢，恶性程度低，虽有多中心性发生倾向且较早出现颈部淋巴结转移，但预后较好（E对）。滤泡状癌发生率仅次于乳头状癌，约占15%多见于50岁左右妇女，肿瘤生长较快，且有血管侵犯倾向及颈部淋巴结转移，属中度恶性，病人预后不如乳头状癌（B错）。髓样癌：约占5%来源于甲状腺滤泡旁细胞（C细胞），可分泌降钙素。肿块质硬，为灰白或灰红色，细胞排列呈巢状、束状、带状或腺管状，无乳头或滤泡结构，呈未分化状。可有颈淋巴结侵犯和血行转移。预后不如乳头状癌，较未分化癌略好（C错）。